随着年龄的增加，根管工作长度不断
A. 减少
B. 增加
C. 不变
D. 可减少，可增加
E. 以上都可能

正确答案：A。减少

解析：本题考查根管的工作长度。根管工作长度是指从牙冠参照点到根尖牙本质牙骨质界的距离。牙本质在人的一生中不断形成。随着年龄的增长，继发性牙本质在根管内壁不断沉积，根尖牙本质牙骨质界也由于牙本质的沉积越来越远离根尖，故随着年龄的增加，根管工作长度不断减少（A对）。